男，55岁。持续胸痛5小时。既往糖尿病10年，吸烟30年。查体：心率35次/分，律齐。心电图示Ⅱ、Ⅲ、aVF导联ST段弓背向上抬高，转运中突然意识障碍，导致该患者意识障碍最可能的心律失常是
A. 心房颤动
B. 左束支传导阻滞
C. 窦性停搏
D. 三度房室传导阻滞
E. 右束支传导阻滞

正确答案：D。三度房室传导阻滞

解析：患者中年男性，有糖尿病史和吸烟史（均为冠心病的危险因素），持续胸痛5小时，心电图示Ⅱ、Ⅲ、aVF导联ST段弓背向上抬高，考虑诊断为急性下壁心肌梗死。下壁心肌梗死最常见的并发症是房室传导阻滞，患者查体：心率35次/分，律齐，突然意识障碍，最可能诊断是下壁心肌梗死导致的三度房室传导阻滞（D对），此时由于心室率极度缓慢，心排出量在短时间内锐减，产生严重脑缺血、晕厥和意识障碍等症状，即阿-斯综合征。心房颤动（P188）（A错）的特征性心电图为P波消失，代之以小而不规则和形态与振幅均变化不定的f波，一般心率在100～160次/分。左束支传导阻滞（B错）和右束支传导阻滞（E错）都可见于急性心肌梗死后，但单支阻滞通常无症状，若左束支和右束支同时阻滞则临床表现与三度房室传导阻滞相同。急性下壁心肌梗死可导致窦性停搏（P183）（C错），若窦性停搏时间过长且无逸搏发生时，可出现意识障碍，但其并非心肌梗死最常见的心律失常。